下列龈沟出血指数的检查方法中，错误的是
A. 检查用视诊和探诊相结合的方法
B. 用钝头牙周探针
C. 可观察牙龈颜色、形状、出血情况
D. 检查前可先检查菌斑指数
E. 轻探龈沟还可观察出血情况

正确答案：D。检查前可先检查菌斑指数

解析：龈沟出血指数（SBI）检查用视诊和探诊相结合的方法，所用探针为钝头牙周探针，检查时除观察牙龈颜色和形状外，还需用牙周探针轻探龈沟，观察出血情况。检查龈沟出血指数前，一般不能检查菌斑指数，因染色剂使用后，会影响龈沟出血情况辨别。掌握“牙周病流行病学及分级预防”知识点。